可识别并切割DNA分子内特异序列的酶称为
A. 限制性外切核酸酶
B. 限制性内切核酸酶
C. 非限制性外切核酸酶
D. 非限制性内切核酸酶
E. DNA酶（DNase）

正确答案：B。限制性内切核酸酶